滑车神经兴奋使同侧瞳孔转向
A. 内下方
B. 外下方
C. 上方
D. 外上方
E. 内上方

正确答案：B。外下方

解析：滑车神经（B对）支配上斜肌，上斜肌使瞳孔转向外下方。